中药材气调养护方法的中心环节是
A. 降氧
B. 控制温度
C. 控制湿度
D. 防止药材变质
E. 环境消毒

正确答案：A。降氧

解析：本题考查的是气调养护技术的内容。中药材气调养护方法的中心环节是降氧（A对）。气调养护技术：气调养护是将药材置于密闭的容器内，对能导致药材发生质变的空气中的氧浓度进行有效的控制，人为地造成低氧状态，或高浓度二氧化碳状态。药材在这样的环境中，不但新的害虫不能产生和侵入，而且原有的害虫将窒息或中毒死亡，微生物的繁殖及药材自身呼吸需要的氧气都受到了抑制，并且阻隔了潮湿空气对药材的影响，从而保证了被贮藏的中药饮片品质的稳定，防止了药材的质变。气调养护不仅可以杀虫、防霉，尚能保持药材原有的色、味，减少成分损失。在高温季节里，还能有效地防止走油、变色等现象发生。气调养护费用低，不污染环境，保存质量好，容易管理，是一项科学而经济的养护方法。控制温度（B错）为低温养护法的重点。低温养护法：一般蛀虫在环境温度8～10℃停止活动，在-8～-4℃进入冬眠状态，温度低于-4℃经过一定时间，可以使害虫致死。采用低温（2～10℃）贮存饮片，就可以有效防止不宜烘、晾中药的生虫、发霉、变色等变质现象发生。梅雨季节来临时，可将饮片贮藏于冷藏库中，温度以2～10℃为宜，不仅能防霉、防虫、防变色、走油，而且不影响药材品质。由于此法需要一定的设备，费用较大，故主要用于贵重药材，特别是容易霉蛀的药材以及无其他较好办法保管的药材。例如哈蟆油、银耳、人参、菊花、山药、枸杞子、陈皮等也常用此法。冷藏最好在梅季前进行，并且过了梅季才可以出库，同时温度不能低于2℃，以免影响饮片的质量。控制湿度（C错）为除湿养护法的重点。除湿养护法：通过养护技术来改变库房的小环境，或利用自然吸湿物，如生石灰等在密封不严条件下吸湿，可起到抑制蛀虫和霉菌生长的作用。常用的方法有通风法和吸湿防潮法。防止药材变质（D错）为中药养护的目的之一。环境消毒（E错）为⁶⁰Coγ-射线灭菌的重点。⁶⁰Coγ-射线灭菌：应用放射性⁶⁰Co产生的γ射线或加速产生的β射线辐照药材时，附着的霉菌、害虫吸收放射能和电荷，很快引起分子电离，从而产生自由基。这种自由基经由分子内或分子间的反应过程，诱发射线化学的各种过程，使机体内的水、蛋白质、核酸、脂肪和碳水化合物等发生不可逆变化，导致生物酶失活，生理生化反应延缓或停止，新陈代谢中断，霉菌和害虫死亡。